男，25岁，头外伤昏迷5分钟后清醒，送医院途中再度陷入昏迷，伴呕吐。体检：浅昏迷，双侧瞳孔等大等圆光反射迟钝，左侧肢体肌力Ⅳ级，巴彬斯基征阳性。若行CT检查，典型表现是
A. 颅内无异常
B. 颅内散在点片状高密度影
C. 颅骨内板与脑表面之间双凸镜形高密度影
D. 颅骨内板下新月形高密度影
E. 脑内圆形高密度影

正确答案：C。颅骨内板与脑表面之间双凸镜形高密度影

解析：硬膜外血肿的典型CT表现为颅骨内板与脑表面之间双凸镜形高密度影（C对）或弓形高密度影。颅内无异常（A错）为脑震荡的CT表现。颅内散在点片状高密度影（B错）为脑挫裂伤的CT表现。颅骨内板下新月形高密度影（D错）为硬脑膜下血肿的CT表现。脑内圆形高密度影（E错）为脑内血肿的CT表现。